恶性淋巴瘤增高的是
A. 碱性磷酸酶
B. 癌胚抗原
C. 乳酸脱氢酶
D. α-酸性糖蛋白
E. α-胚胎抗原

正确答案：C。乳酸脱氢酶

解析：恶性淋巴瘤增高的是乳酸脱氢酶（C对），提示预后不良。碱性磷酸酶（A错）对骨肿瘤的诊断具有特异性，恶性淋巴瘤患者出现碱性磷酸酶增高提示侵犯骨骼；癌胚抗原（B错）增高、α-胚胎抗原（E错）增高常见于消化道肿瘤；α-酸性糖蛋白（D错）增高见于肺癌。